人字缝位于
A. 额骨、顶骨和颞骨之间
B. 两侧顶骨和枕骨之间
C. 两侧颞骨和顶骨之间
D. 额骨和双侧顶骨之间
E. 左右顶骨之间

正确答案：B。两侧顶骨和枕骨之间

解析：两侧顶骨与枕骨连结成人字缝 （B对）。